属于对症治疗的是
A. 阻止毒物继续进入人体内，促使毒物排泄以及拮抗或解除其毒作用
B. 缓解毒物引起的主要症状，以促进人体功能的恢复
C. 提高患者抗病能力，促使早日恢复健康
D. 降低车间空气中毒物浓度
E. 加强个人防护和个人卫生

正确答案：B。缓解毒物引起的主要症状，以促进人体功能的恢复

解析：本题考查对症治疗的作用。职业中毒的治疗可分为病因治疗、对症治疗和支持疗法三类。及时合理的对症处理是缓解毒物引起的主要症状，促进机体功能恢复（B对ACDE错）的重要措施。